各类型休克的根本变化是
A. 代谢性酸中毒
B. 脉搏快
C. 尿量少
D. 组织灌注不足
E. 低血压

正确答案：D。组织灌注不足

解析：休克是机体有效血容量减少、组织灌注不足、细胞代谢紊乱和功能受损的病理过程，其根本变化是组织灌注不足（D对）。代谢性酸中毒（A错）为休克的代谢改变，脉搏快（B错）、尿量少（C错）、低血压（E错）为休克的临床表现。